心力衰竭时，下列哪种代偿反应不正确
A. 血容量增加
B. 红细胞增加
C. 组织利用氧的能力减少
D. 血液重新分布
E. 肾小球滤过率降低

正确答案：C。组织利用氧的能力减少

解析：心衰时，心脏以外的代偿主要包括血容量增加（A对）和血液重新分布（D对）。为保证心衰时重要器官如心、脑的灌注，外周血管选择性收缩，引起血液重新分布，表现为部分器官灌注减少，尤以肾脏显著，因而肾小球滤过率降低（E对）。另外，心衰引起的慢性缺氧可刺激骨髓造血，使红细胞增加（B对），组织细胞通过增加线粒体的数量、增强部分酶的活性以增加利用氧的能力（C错，为本题正确答案）。